激活糜蛋白酶原的是
A. 肠致活酶
B. 胰蛋白酶
C. 盐酸
D. 组胺
E. 辅酯酶

正确答案：B。胰蛋白酶